延髓前正中裂与前外侧沟之间为
A. 小脑下脚
B. 橄榄
C. 锥体
D. 薄束结节
E. 无

正确答案：C。锥体

解析：延髓前正中裂与前外侧沟之间为锥体（C对）；小脑下脚（A错）为楔束结节外上方的隆起；橄榄（B错）为锥体上部背外侧的卵圆形隆起；在延髓后正中沟的两侧各有两个膨大，内侧者为薄束结节（D错）。